下列抗癫痫药物中，属于肝药酶诱导剂的有
A. 奥卡西平
B. 苯妥英钠
C. 地西泮
D. 丙戊酸钠
E. 卡马西平

正确答案：A、B、E。奥卡西平；苯妥英钠；卡马西平

解析：本题考查抗癫痫药物。属于肝药酶诱导剂的有：奥卡西平（A对）、苯妥英钠（B对）、卡马西平（E对）；地西泮（C错）为镇静催眠药，丙戊酸钠（D错）为传统型抗癫痫药，两者均无肝药酶诱导作用。